不属于粮豆主要卫生问题的是
A. 真菌及其毒素污染
B. 细菌及其毒素污染
C. 农药残留
D. 仓储害虫
E. 重金属污染

正确答案：B。细菌及其毒素污染

解析：本题考查粮豆的主要卫生问题。粮豆的主要卫生问题有：1.真菌及其毒素的污染（A对）；2.农药残留（C对）；3.其他有害化学物质的污染：如重金属污染（E对）；4.仓储害虫（D对）；5.其他问题：如自然陈化、有毒植物种子的污染、无机夹杂物的污染、掺杂、掺假等。细菌及其毒素污染（B错，为本题正确答案）不是粮豆的主要卫生问题。